男性，55岁，反复不规律上腹部胀痛3年，胃镜诊断为萎缩性胃炎。判断该患者炎症活动的客观依据是
A. 胃粘膜肠上皮化生
B. 胃粘膜出血
C. 胃粘膜内中性粒细胞增多
D. 胃粘膜中增多的主要是淋巴细胞
E. 胃粘膜纤维组织增生

正确答案：C。胃粘膜内中性粒细胞增多

解析：中老年男性患者，诊断为萎缩性胃炎，炎症的活动性是指中性粒细胞出现，胃黏膜内中性粒细胞增多（C对）是该患者炎症活动的客观依据。胃黏膜肠上皮化生（A错）为化生型萎缩性胃炎的特征；胃黏膜出血（B错）可表明急性胃黏膜损伤；淋巴细胞（D错）是慢性萎缩性胃炎常见的浸润细胞；胃黏膜纤维组织增生（E错）在萎缩性胃炎中不常见。